下列给药途径中注射液的处方不能添加抑菌剂的是
A. 肌肉注射
B. 静脉输注
C. 脑池内注射
D. 硬膜外注射
E. 椎管内注射

正确答案：B、C、D、E。静脉输注；脑池内注射；硬膜外注射；椎管内注射

解析：本题考查注射剂。抑菌剂只有在必要时加入，一般绝大多数注射剂均不需要加入抑菌剂，供静脉（B错，为本题正确答案）、脑池内（C错，为本题正确答案）、硬膜外（D错，为本题正确答案）或椎管内（E错，为本题正确答案）用注射剂，除特殊规定外，一般均不得加入抑菌剂。